研究者对某铜矿厂全体男职工共150人开展一项前列腺癌筛查研究，筛查出阳性为100人，其中有73人确诊为前列腺癌；阴性为50人，确诊没有前列腺癌的为43人。则该检测方法的灵敏度为
A. 0.87
B. 0.91
C. 0.69
D. 0.5
E. 0.33

正确答案：B。0.91

解析：灵敏度又叫真阳性率，指确诊的病例中试验判断为阳性者所占的百分比，用a代表真阳性，b代表假阳性，c代表假阴性，d代表真阴性，灵敏度=a/a+c=73/73+7=0.91（B对）。